患者上前牙外伤，就诊。查：左上1牙冠松动Ⅲ度，牙龈出血，叩（++），X线示：根折位于颈1/3处，剩余根长约15mm，该牙处理为
A. 固定
B. 拔除患牙
C. 拔除牙冠部分，直接修复
D. 拔除牙冠部分，根部行根管治疗
E. 直接光敏粘着修复

正确答案：D。拔除牙冠部分，根部行根管治疗

解析：本题考查根折的治疗。患者上前牙外伤，就诊。查：左上1牙冠松动Ⅲ度，牙龈出血，叩（++），X线示：根折位于颈1/3处，剩余根长约15mm，该牙处理为拔除牙冠部分，根部行根管治疗（D对）。根折位于颈1/3处，剩余根长约15mm，断根长于中切牙的冠长，则可以拔除牙冠部分，根部行根管治疗，然后进行牙冠延长术，术后3个月行桩核冠修复。颈1/3根折，有牙龈出血，与龈沟相交通，不会出现自行修复，且固定效果欠佳（A错）。拔除患牙适用于患牙纵折或冠根联合折已不能进行根管治疗或桩核冠修复的情况，该患牙余留牙根足够长，可以利用牙根作桩核冠修复，不应拔除（B错）。拔除牙冠部分后，若直接修复，患牙断面位于龈下不利于修复，而根管内的残余牙髓不处理亦会出现炎症，导致修复失败（C错）。直接光敏粘着修复适用于冠折缺损少，无牙本质敏感，未露髓的情况（E错）。